29岁，停经10周，下腹部阵发性剧痛，阴道流血超过月经量，子宫颈口1指松，宫体鸭卵大，处置是
A. 黄体酮保胎
B. 卧床休息，口服鲁米那
C. 刮宫术
D. 肌注催产素
E. 等待自然流产

正确答案：C。刮宫术

解析：本例下腹部阵发性剧痛，阴道流血超过月经量，子宫颈口已开，故诊断为难免流产。难免流产一经确诊，应尽早使胚胎及胎盘组织完全排出。早期流产应及时行刮宫术。故选C。掌握“自然流产”知识点。